患者食欲和记忆力减退，检查：眼睑苍白，血红细胞白细胞和血小板均减少。应首先考虑的是
A. 再生障碍性贫血
B. 缺铁性贫血
C. 溶血性贫血
D. 失血性贫血
E. 巨幼红细胞性贫血

正确答案：A。再生障碍性贫血

解析：再生障碍性贫血（aplasticanemia，AA）简称再障，是由多种病因引起的骨髓造血功能衰竭，出现以全血细胞减少为主要表现的一组综合征。临床表现为较严重的贫血、感染和出血（A对）。缺铁性贫血（irondeficientanemia，IDA）是指缺铁所引起的小细胞低色素性贫血及相关的缺铁异常，是血红蛋白合成异常性贫血的一种。其特点是骨髓、肝、脾等器官组织中缺乏可染色性铁，血清铁浓度、转铁蛋白饱和度和血清铁蛋白降低（B错）。溶血性贫血（hemolyticanemia，HA）是由于红细胞的破坏加速、增多，超过造血补偿能力时所发生的一类贫血（C错）。急性失血后贫血是快速大量出血引起的贫血；慢性失血后贫血是由于长期中度出血所致的小细胞性贫血。如见于慢性胃肠道疾病（例如消化性溃疡或痔疮），泌尿系或妇科的慢性出血（D错）。巨幼红细胞性贫血简称巨幼贫多因缺乏维生素B12或（和）叶酸所致。孕前或孕中缺乏维生素B12或者叶酸可能会患上这种疾病（E错）。